用下列哪种消毒剂浸泡的器械使用前需用灭菌蒸馏水冲洗
A. 乙醇
B. 戊二醛
C. 碘伏
D. 福尔马林
E. 含氯消毒剂

正确答案：D。福尔马林

解析：本题考查消毒与灭菌-化学灭菌法。福尔马林（D对），即甲醛的水溶液，是一种慢性中毒药物。人体长期接触低剂量的福尔马林会引起慢性呼吸道疾病、女性月经紊乱、新生儿体质降低甚至鼻咽癌等病症，若人体皮肤直接接触福尔马林时，可能会引发过敏反应、皮肤炎或是湿疹，故经福尔马林浸泡的器械使用前需用灭菌蒸馏水冲洗。75%的乙醇溶液（A错）消毒效果最好，常用于医疗消毒，对人体刺激很小，其所浸泡的器械使用前无需用灭菌蒸馏水冲洗，可直接使用。戊二醛（B错）在使用浓度下，具有刺激性小、腐蚀性低、安全低毒的优点，其浸泡的器械使用无前需用灭菌蒸馏水冲洗。碘伏（C错）在医疗上用作杀菌消毒剂，可用于皮肤、黏膜的消毒，其浸泡的器械可直接使用。含氯消毒剂（E错）对皮肤、黏膜刺激较小，其浸泡的器械可直接使用，不需要用灭菌蒸馏水冲洗。